下列哪种囊肿来源于缩余釉上皮
A. 含牙囊肿
B. 牙源性角化囊肿
C. 根尖囊肿
D. 发育性根侧囊肿
E. 牙龈囊肿

正确答案：A。含牙囊肿

解析：本题考查来源于缩余釉上皮的囊肿。含牙囊肿来源于缩余釉上皮（A对）。牙源性角化囊肿，即牙源性角化囊性瘤，可能来自牙板上皮剩余、Serres上皮岛或口腔黏膜（B错）。根尖囊肿来源于Malassez上皮剩余（C错）。发育性根侧囊肿（D错）和牙龈囊肿（E错）来源于牙板上皮剩余或Serres上皮剩余。